抗癌平丸主治热毒瘀血阻滞所致的食管癌或直肠癌，其功能是
A. 清热泻火，利尿通便
B. 清肺利肺，降逆除烦
C. 清热泻火，散风止痛
D. 清胃泻火，解毒消肿
E. 清热解毒，散瘀止痛

正确答案：E。清热解毒，散瘀止痛

解析：本题考查的是抗癌平丸的功能。抗癌平丸主治热毒瘀血阻滞所致的食管癌或直肠癌，其功能是清热解毒，散瘀止痛（E对）。抗癌平丸：【功能】清热解毒，散瘀止痛。黛蛤散：【功能】清肝利肺，降逆除烦（B错）。牛黄上清丸：【功能】清热泻火，散风止痛（C错）。清胃黄连丸：【功能】清胃泻火，解毒消肿（D错）。功能为清热泻火，利尿通淋（A错）的中成药，2022年考试指南未明确说明。